下列情形中，应按假药论处的是
A. 擅自添加矫味剂
B. 将生产批号“13524”更改为“120328”
C. 以淀粉冒充感冒片
D. 片剂表面霉迹斑斑
E. 适应症项下删除“治疗感冒引发的鼻塞”的表述

正确答案：C、D。以淀粉冒充感冒片；片剂表面霉迹斑斑

解析：本题考查假药的界定。下列情形中，属于假药的是以淀粉冒充感冒片（C对）、片剂表面霉迹斑斑（D对）。假药的界定：《药品管理法》第九十八条第一款、第二款规定，禁止生产（包括配制，下同）、销售、使用假药。有下列情形之一的，为假药：①药品所含成分与国家药品标准规定的成分不符；②以非药品冒充药品或者以他种药品冒充此种药品；③变质的药品；④药品所标明的适应症或者功能主治超出规定范围。劣药的界定：根据《药品管理法》第九十八条第三款规定，有下列情形之一的，为劣药：①药品成分的含量不符合国家药品标准；②被污染的药品；③未标明或者更改有效期的药品；④未注明或者更改产品批号的药品（B错）；⑤超过有效期的药品；⑥擅自添加防腐剂、辅料的药品（A错）；⑦其他不符合药品标准的药品。